某男，19岁。患慢性肾炎8年，日前突发眼睑浮肿，遂来就诊。刻下恶寒、发热、无汗、肢体酸楚、不欲饮水、脉浮滑。医师诊断为风水水肿，治当宣肺利水。处方：麻黄9g，苦杏仁10g，防风6g，浮萍10g，茯苓10g，泽泻10g，车前子15g（包煎），紫苏叶6g（后下）。服药2周后，恶寒、眼睑浮肿已消，又见下肢浮肿，伴倦怠、便溏，苔白、脉滑。证属脾虚水湿内停，治当补气健脾利水，处方中宜加用的药组是
A. 羌活、槟榔
B. 连翘、赤小豆
C. 白扁豆、桂枝
D. 陈皮、桑白皮
E. 黄芪、白术

正确答案：E。黄芪、白术

解析：本题考查黄芪、白术的功效。证属脾虚水湿内停，治当补气健脾利水，处方中宜加用的药组是黄芪、白术（E对）。黄芪【功效】补气升阳，益卫固表，托毒生肌，利水消肿。白术【功效】补气健脾，燥湿利水，止汗，安胎。黄芪、白术，均性偏温，为温补兼利水之品，同能补气利尿、固表止汗，治脾虚气弱，水湿内停之水肿、小便不利，以及气虚自汗。羌活【功效】解表散寒，祛风胜湿，止痛。槟榔（A错）【功效】杀虫，消积，行气，利水，截疟。连翘【功效】清热解毒，疏散风热，消肿散结，利尿。赤小豆（B错）【功效】利水消肿，解毒排脓。白扁豆【功效】健脾化湿，消暑解毒。桂枝（C错）【功效】发汗解肌，温通经脉，助阳化气。陈皮【功效】理气调中，燥湿化痰。桑白皮（D错）【功效】泻肺平喘，利水消肿。